男，43岁，肝炎肝硬化病史5年，出现腹水1年，1周来低热伴轻度腹痛，腹水明显增多。腹水检查：淡黄色，比重1.017，蛋白26g/L，白细胞数500×10⁶/L，中性粒细胞0.80.最可能的诊断是肝硬化合并
A. 结核性腹膜炎
B. 自发性腹膜炎
C. 原发性肝癌
D. 门静脉血栓形成
E. 肝肾综合征

正确答案：B。自发性腹膜炎

解析：中年男性患者，既往有肝炎、肝硬化及腹水病史，1周来低热伴轻度腹痛，腹水明显增多，符合自发性腹膜炎的特点：发热、腹痛、腹水增加。腹水检查：比重1.017，蛋白26g／L，白细胞数500×10⁹／L，以中性粒细胞为主，提示腹水介于漏出液和渗出液之间。综合患者病史、体检与腹水检查，考虑诊断为自发性细菌性腹膜炎（B对）。结核性腹膜炎（P370）（A错）腹水表现为渗出液，蛋白质定量在30g/L以上，白细胞以淋巴细胞或单核细胞为主。原发性肝癌（P416）（C错）表现为肝区疼痛、肝大、黄疸、肝硬化征象、进行性消瘦、发热、食欲不振、乏力、营养不良和恶病质等，其腹水一般呈漏出液表现。门静脉血栓形成（P409）（D错）急性或亚急性发展时，表现为中、重度腹胀痛或突发剧烈腹痛、脾大、顽固性腹水、肠坏死、消化道出血及肝性脑病等，腹穿可抽出血性腹水。肝肾综合征（P409）（E错）临床主要表现为少尿、无尿及氮质血症。